病例表现为中性粒细胞浸润的肉芽肿疾病为
A. 猫抓病
B. 组织坏死性淋巴结炎
C. 结核性淋巴结炎
D. 结节病
E. 反应性淋巴结炎

正确答案：A。猫抓病

解析：猫抓病的病理变化是由组织细胞演变的上皮样细胞形成肉芽肿，肉芽肿中央可见中性粒细胞浸润（A对）。组织坏死性淋巴结炎一般表现为中性粒细胞稀少或缺如（B错）。结核一般表现为巨噬细胞浸润（C错）。结节病一般为淋巴细胞和巨噬细胞浸润（D错）。反应性淋巴结炎一般是大量的B细胞、T细胞聚集（E错）。